县级以上地方人民政府
A. 应当接受疾病预防控制机构或者出入境检验检疫机构的流行病学调查和指导
B. 应当为艾滋病患者提供艾滋病防治咨询、诊断和治疗服务
C. 向接受艾滋病咨询、检测的人员免费提供咨询和初筛检测
D. 应当按照属地管理的原则，对艾滋病患者进行医学随访
E. 应当对采集的人体血浆进行艾滋病检测

正确答案：C。向接受艾滋病咨询、检测的人员免费提供咨询和初筛检测